属于靶向制剂的是
A. 硝苯地平渗透泵片
B. 利培酮口崩片
C. 利巴韦林胶囊
D. 注射用紫杉醇脂质体
E. 水杨酸乳膏

正确答案：D。注射用紫杉醇脂质体

解析：本题考查靶向制剂。注射用紫杉醇脂质体（D对）属于靶向制剂。靶向制剂有多种分类方式，按照靶向原动力可以分为被动靶向制剂、主动靶向制剂和物理化学靶向制剂三大类。常见物理化学靶向制剂包括：磁性靶向制剂、热敏靶向制剂、pH敏感靶向制剂、栓塞性制剂。主动靶向制剂包括：常见的前体药物如抗癌的前体药物、脑部靶向前体药物；修饰的药物载体如修饰性的脂质体、修饰的微球、修饰的纳米球等。常见的被动靶向制剂有脂质体、微乳、微囊、微球、纳米粒等。硝苯地平渗透泵片（A错）属于渗透泵型控释片，属于控释制剂；口崩片（B错）属于快速释放制剂；利巴韦林胶囊（C错）和水杨酸乳膏（E错）为干扰选项。